全血在保存过程中，发生了“保存损害”，丧失了一些有用成分，它们是
A. 血小板、粒细胞、不稳定的凝血因子
B. 红细胞、白细胞、血小板
C. 白细胞、血小板、稳定的凝血因子
D. 白细胞、血小板、纤维蛋白原
E. 血小板、淋巴细胞、凝血因子Ⅶ

正确答案：A。血小板、粒细胞、不稳定的凝血因子

解析：正常人体内红细胞的平均寿命约为120天；粒细胞的寿命约为4～5天；白细胞寿命一般也只有几天；血小板生成后，寿命约为7～14天，但它只在最初两天具有生理功能，即处于离体情况下的全血，血小板只有约1～2天的寿命；在体外条件下，不稳定的凝血因子一定比稳定的凝血因子丧失的更快；纤维蛋白原若没有被凝血途径激活，则可以保存很久；凝血因子Ⅶ为维生素K依赖的凝血因子，为稳定性因子，可以保存一定时间。全血在保存过程中为离体血液，其中最容易发生“保存损害”的主要为不稳定的凝血因子、粒细胞、血小板（A对），其次为白细胞、淋巴细胞、稳定的凝血因子、纤维蛋白原和红细胞（BCDE错）。